男，30岁，因车祸面部外伤2天，检查见两侧面部不对称，左侧下睑肿胀、瘀血，口内检查左侧后牙早接触。首先应拍照下列哪个片位
A. 上颌体腔
B. 上颌前部（牙合）片
C. 上颌正位体层
D. 华特位
E. 颧骨后前位

正确答案：D。华特位

解析：本题考查华特位片的正常图像。上颌骨损伤时一般通过X线平片即可了解骨折的部位、数目、方向、类型、骨折移位和牙与骨折线的关系等情况。上颌骨外伤可选用华特位（D对），它可显示上颌骨各腔窦的位置和情况，利于了解骨折情况。上颌体腔（A错）多用于观察上颌骨各腔窦的病变，该病例中患者两侧面部不对称，应首先重点了解是否有骨折的情况。上颌前部（牙合）片（B错）只显示上颌前部的情况，不能了解整个上颌骨的骨折情况。上颌正位体层（C错）片常用于观察上颌病变及其与上颌窦、筛窦、眶底、鼻腔和颅底的关系，以确定上颌肿瘤是否累及翼突及颅底。颧骨后前位（E错）主要用于检查颧骨和颧弓骨折，病例中患者左侧后牙早接触，考虑有下颌骨或上颌骨骨折，故应首先重点检查上下颌骨骨折情况。